女，47岁，右上34缺失，需固定修复。如果设计不当，固定义齿易产生整体
A. 近中移动
B. 远中移动
C. （牙合）向移动
D. 龈向移动
E. 唇颊向移动

正确答案：C。（牙合）向移动

解析：本题考查固定义齿修复可能出现的问题及原因。此患者右上34缺失，需设计以右上521为基牙的双端固定桥，由于同时涉及前牙和后牙，如果设计不当，当受到垂直向不均衡（牙合）力时，后基牙承受的（牙合）力大，若后基牙为固位力较小的设计，有可能发生松动脱落，即发生整体（牙合）向移动（C对）；若后基牙固位良好，力过大时，会损伤牙周组织。对于双端固定桥，接受的是均衡的唇向或颊向的力，运动方向基本一致，若基牙稳固，固位体固位良好，不易产生唇颊向移动（E错）。当基牙固位体洞型过浅或轴壁过分（牙合）向集中，特别是使用邻（牙合）嵌体作为固位体时，受到近远中向的倾斜力时才有可能发生近远中向移动（AB错）。